下列哪项是指以改善健康为主要目的所有组织、机构和资源的总和
A. 生态系统
B. 社会系统
C. 国家系统
D. 神经系统
E. 卫生系统

正确答案：E。卫生系统

解析：广义的卫生系统是指以改善健康为主要目的所有组织、机构和资源的总和。掌握“卫生系统及功能”知识点。